下列各项，不属于人工流产并发症的是
A. 人流综合征
B. 子宫穿孔
C. 人流后宫缩不良
D. 人流不全
E. 人流术后感染

正确答案：C。人流后宫缩不良

解析：人流后宫缩不良这是正常的，不属于人工流产并发症（C错，为本题正确答案）。人工流产并发症有人流综合征（A对）、子宫穿孔（B对）、人流不全（D对）、宫腔或宫颈管内口粘连、人流术后感染（E对）。